面部疼痛突然发作，呈闪电样、刀割样剧痛，持续数秒到2分钟，痛处有灼热感，流涎，目赤流泪，苔薄黄，脉数。治疗除取主穴外，还应选取
A. 丝竹空、阳白、外关
B. 颧髎、迎香
C. 列缺、太阳
D. 曲池、尺泽
E. 太冲、三阴交

正确答案：D。曲池、尺泽

解析：本题考查常见的病症的辩证、处方。面部疼痛突然发作，呈闪电样、刀割样剧痛，持续数秒到2分钟可诊断为面痛。面痛多与外感邪气、情志不调、外伤因素有关，治法当以疏通经络，祛风止痛为主。以足太阳及手足阳明经穴为主，该患者痛处有灼热感，流涎，目赤 流泪，苔黄，脉数为风热证，故选取风池、曲池为配穴，尺泽亦能泻热，（D对）。丝竹空、阳白、外关为治疗面第1支痛的主穴（A错）。颧髎、迎香为治疗面第2支痛的主穴（B错）。列缺为治疗面痛风寒证的穴位（C错）。太冲为治疗面痛气滞血瘀的穴位（E错）。